薄束和楔束
A. 是第二级传入纤维组成
B. 其细胞体位于后角
C. 其纤维止于丘脑外侧核
D. 是由同侧的脊髓神经节发出的纤维组成
E. 仅传递精细触觉冲动

正确答案：A。是第二级传入纤维组成

解析：薄束和楔束参与躯干和四肢意识性本体感觉的精细触觉传导通路的构成。该通路由3级神经元组成：第1级神经元为脊神经节内假单极神经元，薄束和楔束是第二级传入纤维组成和胞体所在（A对B错），最后止于背侧丘脑腹后外侧核（C错）。第3级神经元的胞体在背侧丘脑腹后外侧核。薄束和楔束传导躯干和四肢意识性本体感觉的精细触觉（E错），是由对侧的脊髓神经节发出的纤维组成（D错）。